全世界于1979年消灭了天花主要是采用了哪一种措施
A. 治疗病人
B. 国境检疫
C. 疫区消毒
D. 接触者留验
E. 普种疫苗

正确答案：E。普种疫苗